因含有强心苷，若使用不慎，容易引起不良反应的中药有
A. 麦冬
B. 罗布麻叶
C. 香加皮
D. 麝香
E. 地骨皮

正确答案：B、C。罗布麻叶；香加皮

解析：本题考查的是含强心苷类化合物的常用中药。因含有强心苷，若使用不慎，容易引起不良反应的中药有罗布麻叶（B对）与香加皮（C对）。罗布麻叶中所含强心苷主要是甲型强心苷。香加皮中含有强心苷类化合物为甲型强心苷，其中杠柳毒苷和杠柳次苷为主要成分。麦冬（A错）含有甾体皂苷，《中国药典》以鲁斯可皂苷元为对照品，测定麦冬总皂苷的含量，要求含量不得少于0.12%。麝香（D错）的化学成分较为复杂，其中的麝香酮是天然麝香的有效成分之一。《中国药典》以麝香酮为指标成分进行含量测定，要求麝香酮含量不得少于2.0%。地骨皮（E错）所含化学成分，2022年考试指南未明确说明。地骨皮含有桂皮酸和多量酚类物质、甜菜碱等。